属于核苷类的抗病毒药物有
A. 齐多夫定
B. 拉米夫定
C. 阿昔洛韦
D. 更昔洛韦
E. 磷酸奥司他韦

正确答案：A、B、C、D。齐多夫定；拉米夫定；阿昔洛韦；更昔洛韦

解析：本题考查核苷类抗病毒药。齐多夫定（A对）、拉米夫定（B对）、阿昔洛韦（C对）、更昔洛韦（D对）属于核苷类抗病毒药。磷酸奥司他韦（E错）属于非核苷类抗病毒药。